五加皮具有的功效是
A. 通便
B. 利尿
C. 凉血
D. 安胎
E. 和胃

正确答案：B。利尿

解析：该题考查五加皮的功效，属记忆内容。五加皮味辛、苦，性温；入肝、肾经；具有祛风湿，补肝肾，强筋骨，利水的功效，可治水肿，小便不利（B对ACDE错）。